具有成瘾性的中枢性镇咳药是
A. 右美沙芬
B. 氯化铵
C. 可待因
D. 苯丙哌林
E. 羧甲司坦

正确答案：C。可待因

解析：本题考查中枢性镇咳药。具有成瘾性的中枢性镇咳药是可待因（C对）。可待因具有中枢性镇痛、镇静作用。在治疗剂量范围内，不良反应比吗啡显著减轻，但过量使用可产生兴奋和惊厥，也具有成瘾性，故应控制剂量与疗程。右美沙芬（A错）通过抑制延髓咳嗽中枢而发挥中枢性镇咳作用，其镇咳强度与可待因相等或略强，主要用于干咳，无镇痛作用。氯化铵（B错）属于刺激性祛痰药，主要用于化痰止咳。苯丙哌林（D错）的镇咳作用兼具中枢性和外周性双重机制；镇咳作用较强，为可待因的2～4倍；无麻醉作用，不抑制呼吸，不引起胆道和十二指肠痉挛，不引起便秘，无成瘾性，未发现耐受性。羧甲司坦（E错）属于黏痰调节剂类祛痰药。